血液中非结合胆红素明显升高见于
A. 溶血性黄疸
B. 肝细胞性黄疸
C. 胆汁淤积性黄疸
D. Dub1n-Johnson综合征
E. 以上都不是

正确答案：A。溶血性黄疸

解析：溶血性黄疸的发生是由于大量红细胞破坏，使非结合胆红素生成增多，超出了肝细胞摄取、转化与排泄能力，导致非结合胆红素潴留。同时，肝细胞转化形成的结合胆红素增多，排入肠道的结合胆红素增加，从而引起尿胆原增多（A对E错）。肝细胞性黄疸为非结合胆红素、结合胆红素均升高（B错）。胆汁淤积性黄疸为结合胆红素升高（C错）。Dubin-Johnson综合征为血清结合胆红素增高（D错）。